久病咳喘，胸闷心悸，乏力少气，自汗声低，舌淡脉弱。其证候是
A. 肺肾气虚
B. 肺气虚
C. 脾肺气虚
D. 心肺气虚
E. 肾气不固

正确答案：D。心肺气虚

解析：久病肺气虚弱，呼吸功能减弱，失于宣降，则咳喘，少气；宗气亏虚，气滞胸中，则胸闷；心气虚弱，鼓动无力，则心悸；气虚，脏腑机能衰退，则乏力声低；肺气虚卫外不固，则自汗；舌淡脉弱，舌淡脉弱为气虚之征，故其证候为心肺气虚证（D对）。肺肾气虚证（又名肾不纳气证）（A错）证候表现为久病咳喘，呼多吸少，气不接续，动则喘甚，腰膝酸冷，舌淡苔白，脉弱。肺气虚（B错）证候表现为面色淡白，自汗咳喘无力，咯痰清稀，少气懒言，动则尤甚，恶风。脾肺气虚（C错）证候表现为久咳不止，气短而喘，咳声低微，食欲不振，面白无华，神疲乏力。肾气不固（E错）证候表现为腰膝酸软，神疲乏力，耳鸣耳聋；小便频数清长，夜尿频多。